流行性乙型脑炎极期最主要的3种凶险症状为
A. 高热、惊厥、循环衰竭
B. 高热、惊厥、呼吸衰竭
C. 高热、昏迷、惊厥
D. 昏迷、惊厥、呼吸衰竭
E. 昏迷、呼吸衰竭、高热

正确答案：B。高热、惊厥、呼吸衰竭